银杏叶中含有的主要化学成分是
A. 槲皮素
B. 山柰素
C. 银杏叶内酯
D. 葛根素
E. 汉黄芩素

正确答案：A、B、C。槲皮素；山柰素；银杏叶内酯

解析：本题考查的是银杏叶的主要化学成分。银杏叶中含有的主要化学成分是槲皮素（A对）、山柰素（B对）与银杏叶内酯（C对）。银杏叶中的黄酮类化合物有黄酮、黄酮醇及其苷类、双黄酮和儿茶素类等。《中国药典》以总黄酮醇苷和萜类内酯为指标成分进行含量测定。要求总黄酮醇苷不少于0.4%，对照品采用槲皮素、山柰素和异鼠李素；要求萜类内酯不少于0.25%，对照品采用银杏内酯A、银杏内酯B、银杏内酯C和白果内酯。葛根素（D错）为葛根的主要化学成分。葛根含异黄酮类化合物，主要成分有大豆素、大豆苷、大豆素-7,4'-二葡萄糖苷及葛根素、葛根素-7-木糖苷。《中国药典》以葛根素为指标成分进行含量测定，要求含葛根素不得少于2.4%。汉黄芩素（E错）为黄芩的主要化学成分。从黄芩中分离出来的黄酮类化合物有黄芩苷（含4.0%～5.2%）、黄芩素、汉黄芩苷、汉黄芩素等20种成分。其中黄芩苷是主要有效成分，具有抗菌、消炎作用。《中国药典》以黄芩苷为指标成分进行含量测定要求药材含量不得少于9.0%，饮片含量不得少于8.0%。